具有抑制磷酸二酯酶，扩张血管和正性肌力作用的药物是
A. 地高辛
B. 氨茶碱
C. 卡托普利
D. 肼屈嗪
E. 硝普钠

正确答案：B。氨茶碱